碳酸锂
A. 可引起瞳孔扩大
B. 可引起呼吸抑制
C. 可引起共济失调
D. 可引起急性心力衰竭
E. 可引起再生障碍性贫血

正确答案：C。可引起共济失调

解析：碳酸锂是一种情绪稳定剂，总体疗效好，副作用不大，但是治疗量和中毒量比较接近且不易控制，一般在服用该药期间要检测血锂浓度，尤其是剂量较大的时候，该药最常见的副作用是震颤和共济失调（C对）以及口中有金属味，有时也会出现腹泻。可引起瞳孔扩大（A错）是阿托品的不良反应。可引起呼吸抑制（B错）为吗啡的不良反应。可引起急性心力衰竭（D错）见于大量输液的患者。可引起再生障碍性贫血（E错）为抗肿瘤药物的常见不良反应。